关于D值与Z值的正确表述有
A. D值系指一定温度下，将微生物杀灭10%所需的时间
B. D值系指一定温度下，将微生物杀灭90%所需的时间
C. D值大，说明该微生物耐热性强
D. D值大，说明该微生物耐热性差
E. Z值系指某一种微生物的D值减少到原来的1/10时，所需升高的温度值（℃）

正确答案：A、D、E。D值系指一定温度下，将微生物杀灭10%所需的时间；D值大，说明该微生物耐热性差；Z值系指某一种微生物的D值减少到原来的1/10时，所需升高的温度值（℃）